缓泻药乳果糖的禁用人群
A. 高血压者
B. 高钾血症者
C. 乳酸血症者
D. 胰腺炎早期者
E. 闭角型青光眼

正确答案：C。乳酸血症者

解析：本题考查药物的禁忌症。缓泻药乳果糖的禁用人群是乳酸血症者（C对）。乳果糖在结肠中被消化道菌丛转化成低分子量有机酸，故乳酸血症患者服用乳果糖可加重酸中毒，因此乳果糖禁用于乳酸血症患者。